根管预备的深度应止于牙本质牙骨质界，通常距根尖孔约
A. 0.5mm
B. 1mm
C. 1.5mm
D. 2mm
E. 根尖1/3处

正确答案：B。1mm

解析：本题考查根管预备的工作长度。牙本质牙骨质界通常位于根管最狭窄处，此处是根管预备的终止点，通常距根尖孔1mm左右（B对）。根管预备止于此，可以防止损伤根尖处的牙周膜，使其新生牙骨质的功能免遭破坏，获得根尖封闭的治愈效果；也可以避免超充。此处所指的根尖孔为组织学根尖孔，应与解剖学根尖孔相区别。解剖学根尖孔是牙根外形的顶点或末端，是根管在牙根表面的开口。